可提供计算机数据库分析的方法是
A. 分馏法
B. 水蒸气蒸馏法
C. 气相色谱--质谱联用法
D. 膜分离法
E. 离子交换法

正确答案：C。气相色谱--质谱联用法

解析：本题考查的是气相色谱--质谱联用法的原理。可提供计算机数据库分析的方法是气相色谱--质谱联用法（C对）。气-质联用，采用气相色谱-质谱-数据系统联用技术，大大加快了挥发油鉴定的速度也提高了研究水平。分析时，首先将样品注入气相色谱仪，经分离后得到的各个组分依次进入分离器，浓缩后的各组分又依次进入质谱仪。质谱仪对每个组分进行检测，通过计算机与数据库的标准谱对照，给出该化合物的可能结构最终还要参考有关文献数据加以确认。分馏法（A错）：是根据物质的沸点进行分离。通常利用中药中各成分沸点的差别进行分离，一般来说，液体混合物沸点相差在100℃以上时，可用反复蒸馏法达到分离的目的，如沸点相差在25℃以下，则需要采用分馏柱，沸点相差越小，则需要的分馏装置越精细。如挥发油和一些液体生物碱的提取分离常采用分馏法。水蒸气蒸馏法（B错）：适用于具有挥发性的、能随水蒸气蒸馏而不被破坏，且难溶或不溶于水的化学成分的提取。此类化合物的沸点多在100℃以上，并在100℃左右有一定的蒸气压。膜分离法（D错）：膜分离法是一种用天然或人工合成的膜，以外界能量或化学位差为推动力，对双组分或多组分的溶质和溶剂进行分离、分级、提纯或富集的方法。目前，膜过滤技术主要包括渗透、反渗透、超滤、电渗析和液膜技术等。离子交换法（E错）：即离子色谱法。离子色谱法是根据物质解离程度不同进行分离。该法系以离子交换树脂作为固定相，以水或含水溶剂作为流动相。当流动相流过交换柱时，溶液中的中性分子及具有与离子交换树脂交换基团不能发生交换的离子将通过柱子从柱底流出，而具有可交换的离子则与树脂上的交换基因进行离子交换并被吸附到柱上，随后改变条件，并用适当溶剂从柱上洗脱下来，即可实现物质分离。